超抗原可被分为
A. 一次超抗原和多次超抗原
B. 适应性超抗原和抑制性超抗原
C. 外源性超抗原和内源性超抗原
D. 固定性超抗原和适应性超抗原
E. 协同性超抗原和拮抗性超抗原

正确答案：C。外源性超抗原和内源性超抗原

解析：超抗原可被分为外源性超抗原和内源性超抗原两类。掌握“抗原基本概念、分类、超抗原及佐剂”知识点。